女，59岁。乏力伴心悸多汗手颤易饿3个月，脾气暴躁。每天大便4～5次，不成形。体重下降6.0kg。查体：甲状腺Ⅱ度肿大质软，心率110次/分，律齐，心音有力。该患者适宜的治疗是
A. 胰岛素
B. 口服泼尼松
C. 口服降血糖药
D. ¹³¹I治疗
E. 抗甲状腺药物

正确答案：E。抗甲状腺药物

解析：中年女性患者，出现乏力伴心悸、多汗、手颤、易饿、脾气暴躁、大便次数增多伴腹泻、体重下降（甲状腺功能亢进症典型症状）。甲状腺Ⅱ度肿大、心率快、心音有力（甲状腺功能亢进症典型体征），考虑诊断为甲状腺功能亢进症。本例患者甲状腺中度肿大，为抗甲状腺药物治疗（E对）的适应证。口服泼尼松（B错）主要用于自身免疫病如溃疡性结肠炎，甲亢发生甲状腺危象时一般使用氢化可的松静滴而非口服。胰岛素（A错）、口服降血糖药（C错）是治疗糖尿病的药物，对甲亢无治疗作用。¹³¹I治疗（D错）适应证为：①甲状腺肿大Ⅱ度以上；②对ATD过敏；③ATD治疗或者手术治疗后复发；④甲亢合并心脏病；⑤甲亢伴白细胞减少、血小板减少或全血细胞减少；⑥甲亢合并肝、肾 等脏器功能损害；⑦拒绝手术治疗或者有手术禁忌证；⑧浸润性突眼。本例患者甲状腺中度肿大，病情较轻，应首选抗甲状腺药物治疗，药物治疗效果不好或复发再使用¹³¹I治疗。